女，31岁，初产妇。妊娠40⁺²周，临产后11小时分娩一女活婴，胎儿娩出35分钟，胎盘未娩出，无阴道流血。查体：P80次/分，BP130/80mmHg，子宫轮廓消失。此时不恰当的处理方法是
A. 下压宫底并用力牵拉脐带
B. 给予缩宫素
C. 建立静脉通道
D. 按摩子宫
E. 探查宫腔和胎盘

正确答案：A。下压宫底并用力牵拉脐带

解析：下压宫底并用力牵拉脐带（A错，为本题正确答案）可能造成产后出血。给予缩宫素（B对）、按摩子宫（D对）有助于子宫恢复正常收缩。建立静脉通道（C对）以及时补充血容量。探查宫腔和胎盘（E对）以明确有无其他损伤。